关于静脉以下何种说法对
A. 均有动脉伴行
B. 体循环静脉分浅、深两类
C. 皆有静脉瓣
D. 壁较动脉厚
E. 无

正确答案：B。体循环静脉分浅、深两类

解析：浅静脉多不与动脉伴行（A错）。体循环静脉分为浅、深静脉（B对）。在躯干较大的静脉少或无瓣膜（C错）。与伴行的动脉相比，静脉管壁薄（D错）而柔软。